刘某等人未经有关部门批准，私设地下血站，非法采集血液，获取可观利益，经群众举报被查获。根据《献血法》规定，对刘某等人可以作出行政处罚的部门是
A. 省级卫生行政部门
B. 省级药品监督管理部门
C. 县级以上地方人民政府卫生行政部门
D. 县级人民政府药品监督管理部门
E. 县级人民政府公安部门

正确答案：C。县级以上地方人民政府卫生行政部门

解析：刘某等人未经有关部门批准，私设地下血站，非法采集血液，并非法获取可观利益，应由县级以上地方人民政府卫生行政部门（C对）予以取缔，没收违法所得，可以并处10万元以下的罚款；构成犯罪的，依法追究刑事责任。